休克时正确的补液原则是
A. 血压正常不必补液
B. 需多少，补多少
C. 补充丧失的部分液体
D. 失多少，补多少
E. 补液宁多勿少

正确答案：B。需多少，补多少

解析：在微循环痪血期输液的原则是“需多少，补多少”（B对ACDE错）。补充血容董应适度，过量输液会导致肺水肿。